恒牙中最早萌的“六龄牙”是
A. 上颌第一磨牙
B. 下颌第一磨牙
C. 上颌第一乳磨牙
D. 下颌第二磨牙
E. 下颌第二乳磨牙

正确答案：B。下颌第一磨牙

解析：本题考查恒牙萌出的顺序。下颌第一磨牙（B对）为恒牙中最早萌的“六龄牙”。下颌恒牙萌出的顺序多为6→1→2→3→4→5→7或6→1→2→4→3→5→7（D错），而一般情况下，下颌牙的萌出较上颌同名牙略早，即下颌第一磨牙先于上颌第一磨牙（A错）萌出。题目所问为恒牙，而上颌第一乳磨牙和下颌第二乳磨牙均为乳牙（CE错）。